具有亢奋偏热多动特征的体质为
A. 肝郁质
B. 阴阳平和质
C. 阳虚质
D. 偏阳质
E. 偏阴质

正确答案：D。偏阳质

解析：偏阳质是具有兴奋、好动、偏热特征的体质类型（D对）。阴阳平和质是功能较为协调的体质类型（B错）。阳虚质的总体特征是阳气不足，以畏寒怕冷、手足不温等虚寒表现为主要特征；心理特征为性格多沉静，内向（C错）。偏阴质是具有抑制、喜静、偏寒特征的体质类型（E错）。